疫源地消毒可分为随时消毒和
A. 即刻消毒
B. 终末消毒
C. 彻底消毒
D. 最后消毒
E. 再次消毒

正确答案：B。终末消毒

解析：本题考查疫源地消毒的分类。疫源地消毒是对现有或曾经有传染源存在的场所进行消毒，可分为随时消毒和终未消毒（B对ACDE错）。随时消毒是指当传染源还在疫源地时，对其排泄物、分泌物、被污染的物品及场所进行的及时消毒。终末消毒是当传染源痊愈、死亡或离开后对疫源地进行的彻底消毒，从而清除传染源所播散在外界环境中的病原体。